使子宫内膜增生的激素是
A. 雌激素
B. 孕激素
C. 雄激素
D. FSH
E. LH

正确答案：A。雌激素

解析：雌激素使子宫内膜腺体及间质增生、修复（A对）。孕激素使增生期子宫内膜转化为分泌期内膜，为受精卵着床做准备（B错）。雄激素过多会对雌激素产生拮抗，如减缓子宫及其内膜的生长、增殖（C错）。FSH是卵泡刺激素是由垂体分泌的，主要是控制人体的生长、发育、青春期的成熟，维持女性特征以及女性皮下脂肪的分布，还促进女性卵泡的发育成熟，促进卵泡颗粒层细胞的增殖、分化（D错）。LH是由脑垂体分泌的一种激素，主要作用是促进性腺分泌性激素（E错）。